某无牙颌患者，上下颌弓位置关系正常，牙槽嵴丰满，上颌相当于3牙槽嵴唇侧尖锐骨尖。此患者在全口义齿修复前需进行
A. 唇颊沟加深
B. 上颌结节修整
C. 牙槽骨修整
D. 唇系带修整
E. 颊系带修整

正确答案：C。牙槽骨修整

解析：本题考查修复前的外科处理。患者牙槽嵴唇侧尖锐骨尖，此患者在全口义齿修复前需进行牙槽嵴修整术（C对），以免义齿制作完成试戴时出现黏膜压痛。唇颊沟加深（A错）用于牙槽嵴吸收严重，牙槽嵴低平，无法提供足够固位力的患者。上颌结节修整（B错）用于上颌结节过大，影响义齿就位的患者。唇系带修整（D错）用于唇系带过短的患者或牙槽嵴吸收严重，与唇系带几乎处于同一水平位置的患者。颊系带修整（E错）用于颊系带影响义齿修复的患者。